给消费者、病人、医务人员提供正确、合适的药品或与药品有关的信息是
A. 执业药师职业道德准则
B. 执业药师执业行为规范
C. 执业药师履行的职责
D. 执业药师行使的权力
E. 执业药师应尽的义务

正确答案：C。执业药师履行的职责